各牙近远中向的倾斜度的描述中，正确的是
A. 下颌中切牙较正
B. 下颌侧切牙稍向近中倾斜
C. 下颌尖牙的倾斜角度较下颌中切牙大
D. 下颌尖牙的倾斜角度较下颌侧切牙大
E. 以上均正确

正确答案：E。以上均正确

解析：本题考查牙列。下颌中切牙较正（A对），侧切牙稍向近中倾斜（B对），尖牙比前两者都大（CD对），但倾斜度均较上颌前牙小。上下前磨牙与第一磨牙向近中倾斜的程度较小并依次减小，最后与中线接近平行。上下颌第二、第三磨牙向近中倾斜度依次加大。综上，以上均正确（E对，为本题正确答案）